结构中含有酯基的药物是
A. 阿司匹林
B. 布洛芬
C. 吲哚美辛
D. 双氯芬酸钠
E. 对乙酰氨基酚

正确答案：A。阿司匹林

解析：本题考查阿司匹林。阿司匹林（A对）分子结果中含有酯键，在潮湿空气中能缓慢水解生成水杨酸和乙酸，应在干燥处保存。布洛芬（B错）为芳基丙酸类非甾体抗炎药，其分子结构中含有甲基和羧基。吲哚美辛（C错）为是芳基乙酸类非甾体抗炎药，其分子结构中含有甲氧基、甲基、羧基、芳酰基。双氯芬酸（D错）为芳基乙酸类药物，其分子结构中含有氨基、羧基。对乙酰氨基酚（E错）为乙酰苯胺类非甾体抗炎药，其分子结构中含有酰胺键。